女，67岁。发热、咳嗽1个月，胸闷3天。体温最高38℃，咳少量痰，近3天感渐进性胸闷，卧位时更明显。曾抗感染治疗效果欠佳。查体：右下胸略膨隆，语音震颤减弱，叩诊实音，呼吸音消失。该患者首先考虑的诊断是
A. 脓胸
B. 阻塞性肺炎
C. 浸润性肺结核
D. 肺炎支原体肺炎
E. 结核性胸膜炎

正确答案：E。结核性胸膜炎

解析：患者为老年女性，发热、咳嗽1个月，胸闷3天，体温最高38℃（体温正常值36℃～37.3℃，即低热，结核感染的表现），咳少量痰。曾抗感染治疗效果不佳（考虑结核感染）。查体：右下胸略膨隆，语音震颤减弱，叩诊实音，呼吸音消失（结核性胸膜炎导致大量胸腔积液的表现），该患者首先应考虑结核性胸膜炎（E对）。脓胸（A错）患者多有高热、咳嗽、咳痰、胸痛等症状。阻塞性肺炎（B错）主要表现为咳嗽、咳痰、气短和呼吸困难。浸润型肺结核（C错）（P68）多发生在肺尖和锁骨下，病灶累及胸膜时会出现胸痛，影像学检查表现为小片状或斑点状阴影，可融合和形成空洞。肺炎支原体肺炎（D错）（P49）多为阵发性刺激性呛咳，主要有乏力、咽痛、头痛、咳嗽、发热、食欲不振、腹泻、肌痛、耳痛等，肺部体检可无明显体征。